下列关于母乳喂养优点的叙述，错误的是
A. 母乳含饱和脂肪酸多，利于婴儿消化吸收
B. 母乳钙磷比例适宜，较少发生低钙血症
C. 母乳含优质蛋白质、必需氨基酸多
D. 母乳有促进婴儿免疫力的作用
E. 哺乳可促进子宫收缩，利于母亲早日康复

正确答案：A。母乳含饱和脂肪酸多，利于婴儿消化吸收

解析：母乳含不饱和脂肪酸多，特别是亚油酸较丰富，还含卵磷脂、鞘磷脂以及牛磺酸、DHA，对小儿脑发育十分重要（A错，为本题正确答案）。母乳钙磷比例适宜，为2：1，钙吸收率较高，较少发生低钙血症（B对）。母乳含优质蛋白质，如乳清蛋白、酪蛋白，在胃内形成的凝块细小柔软，适合婴儿消化吸收，必需氨基酸多（C对）。母乳中含有丰富的抗体、活性细胞和其他免疫活性物质，有促进婴儿免疫力的作用（D对）。哺乳可促进母亲分泌催产素，加强子宫收缩，利于母亲早日康复（E对）。